《中国药典》2015年版（一部）规定，斑蝥素的含量测定方法是
A. 气相色谱法
B. 红外分光光度法
C. 高效液相色谱法
D. 薄层色谱扫描法
E. 紫外—可见分光光度法

正确答案：C。高效液相色谱法

解析：本题考查的是中药安全性检测。《中国药典》2015年版（一部）规定，斑蝥素的含量测定方法是高效液相色谱法（C对）。《中国药典》对毒性成分的测定多采用高效液相色谱法，如制川乌、制草乌、附子中的双酯型生物碱（以含新乌头碱、次乌头碱、乌头碱的总量计）进行限量检查；马钱子中的士的宁，斑蝥中的斑蝥素等。有毒中药药材加工成饮片后，毒性成分减少，如《中国药典》规定乌头碱、次乌头碱和新乌头碱的总量在川乌药材中应为0.050%～0.17%，在制川乌饮片中不得过0.040%；士的宁在马钱子药材中应为1.20%～2.20%，在马钱子粉中应为0.78%～0.82%。气相色谱法（A错）可用于测定药材农药残留量。《中国药典》采用气相色谱法测定药材及制剂中部分有机氯、有机磷和拟除虫菊酯类的农药残留量。红外分光光度法（B错）可用于鉴别。紫外-可见分光光度法（E错）可用于鉴别和含量测定。薄层色谱扫描法（D错），2022年考试指南未明确说明。